男，35岁。突发右侧腰部剧痛半天。尿常规红细胞满视野，相差显微镜红细胞为正常形态。最可能的原因为
A. 左肾静脉受压
B. 尿路结石
C. 泌尿系肿瘤
D. 肾小球肾炎
E. 尿路感染

正确答案：B。尿路结石

解析：青年男性患者，突发右侧腰部剧痛，尿常规红细胞满视野，相差显微镜红细胞为正常形态（提示非肾小球源性血尿），结合患者临床表现和尿液检查，最可能的原因为尿路结石（B对）。结石引起泌尿系梗阻，导致梗阻上端平滑肌剧烈收缩痉挛，产生剧痛，结石损伤黏膜，导致粘膜出血，引起血尿。左肾静脉受压（A错）即胡桃夹综合征，是指左肾静脉回流入下腔静脉过程中在穿经由腹主动脉和肠系膜上动脉形成的夹角或腹主动脉与脊柱之间的间隙内受到挤压，多见于体型瘦长的青少年，以血尿和直立性蛋白尿为主要表现，尿红细胞形态多正常。泌尿系肿瘤（C错）起病较缓慢，主要表现为间歇无痛肉眼血尿、腰痛和腹部肿块。肾小球肾炎（D错）主要表现为血尿、蛋白尿、水肿和高血压，相差显微镜可见变形的红细胞。尿路感染（E错）起病急骤，多有尿频、尿急、尿痛的膀胱刺激征，尿液检查可见大量红、白细胞，尿细菌培养检查可确诊。